根据《中华人民共和国行政处罚法》，可以适用简易程序的是
A. 对公民处200元以下罚款
B. 对公民处500元罚款
C. 没收非法所得
D. 吊销许可证
E. 行政拘留

正确答案：A。对公民处200元以下罚款

解析：本题考查的是行政处罚的程序。根据《中华人民共和国行政处罚法》，可以适用简易程序的是对公民处200元以下罚款（A对）。行政处罚的程序：1.行政处罚的决定及其程序：公民、法人或者其他组织违反行政管理秩序的行为，依法应当给予行政处罚。行政机关在作出行政处罚决定之前，应当告知当事人作出行政处罚决定的事实、理由及依据，并告知当事人依法享有的权利。行政处罚决定程序有2大类。（1）简易程序（当场处罚程序）：当违法事实清楚、有法定依据、拟作出数额较小的罚款（对公民处200元以下，对法人或者其他组织处3000元以下的罚款）或者警告时，可以适用简易程序，当场处罚。简易程序包括：①表明身份（执法人员应向当事人出示执法身份证件）。②确认违法事实，说明处罚理由和依据。③制作行政处罚决定书。④交付行政处罚决定书。⑤备案。（2）一般程序（普通程序）：一般程序包括：①立案。对于在两年以内未发现的行政违法行为，不予立案追究。②调查。调查时，行政执法人员不得少于二人，并应出示证件。③处理决定。根据不同情况，分别作出行政处罚、不予行政处罚和移送司法机关处理决定。④说明理由并告知权利。⑤当事人的陈述和申辩。⑥制作处罚决定书。⑦送达行政处罚决定书。2.听证程序：行政机关作出责令停产停业、吊销许可证或者执照（D错）、较大数额罚款等行政处罚决定之前，应当告知当事人有要求举行听证的权利；当事人要求听证的，行政机关应当组织听证。当事人不承担行政机关组织听证的费用。听证程序包括：（1）听证申请的提出：当事人要求听证的，应当在行政机关告知后三日内提出。（2）听证通知：行政机关应当在听证的七日前，将举行听证的时间、地点和其他相关事项通知当事人。（3）听证的主持与参与：听证应由行政机关指定非本案调查人员主持。当事人有权申请听证主持人回避。当事人可亲自参加，也可委托一至二人代理参加。（4）辩论：举行听证时，调查人员提出当事人违法的事实、证据和行政处罚建议；当事人进行申辩和质证。（5）制作听证笔录：笔录应当交当事人审核无误后签字或者盖章。财产罚：是指行政主体依法对违法行为人给予的剥夺财产权的处罚形式。财产罚是运用最广泛的一种行政处罚，其形式主要有罚款和没收财物（没收违法所得、没收非法财物等）两种。罚款，是行政主体依法强制违法行为人在一定期限内交纳一定数额货币的一种处罚方式，《药品管理法》中运用相当广泛。没收违法所得（C错）、没收非法财物，是行政主体依法将违法行为人的违法所得、违禁物品、违法行为工具等强制收归国有的一种处罚形式。以强制手段剥夺违法行为人的财产权，以此达到惩罚目的。药品行政处罚中的没收内容包括没收非法财物（药品、假药、劣药）、没收违法所得、没收与违法行为有关的其他财物等。人身罚：是指特定行政主体限制和剥夺违法行为人人身自由的行政处罚，如行政拘留（E错）。《行政处罚法》规定，“限制人身自由的行政处罚，只能由法律设定”。《药品管理法》规定，对生产销售假药和生产销售劣药情节严重的，以及伪造编造许可证件、骗取许可证件等情节恶劣的违法行为，可以由公安机关对相关责任人员处五日至十五日的拘留。